疱疹性咽峡炎的病原是
A. 衣原体
B. 呼吸道合胞病毒
C. 流感病毒
D. 腺病毒
E. 柯萨奇病毒

正确答案：E。柯萨奇病毒

解析：疱疹性咽峡炎由柯萨奇A组病毒所致，好发于夏秋季，表现为急性发热，体温大多在39℃以上，流涎、咽痛等，体检时可见咽部红肿，咽腭弓、悬雍垂、软腭等处可见2～4mm大小的疱疹，周围红晕，疱疹破溃后形成小溃疡，病程约1周左右（E对）。衣原体（A错）为介于立克次体和病毒之间的微生物，可引起沙眼、肺炎及泌尿道感染等多种疾病。呼吸道合胞病毒（B错）属副黏液病毒科，是引起小儿病毒性肺炎最常见的病原，可引起间质性肺炎，毛细支气管炎等。流感病毒（C错）属正黏液病毒科，可引起甲型流感、禽流感等多种急性呼吸道传染病。腺病毒（D错）可引起急性发热性咽喉炎、咽-结合膜热、肺炎等多种疾病。